牙菌斑中“玉米棒”结构主要是由
A. 拟杆菌与链球菌组成
B. 微球菌与链球菌组成
C. 梭状菌与拟杆菌组成
D. 丝状菌与球菌组成
E. 螺旋体与球菌组成

正确答案：D。丝状菌与球菌组成

解析：本题考查牙周炎病因学。玉米棒结构，是成熟菌斑表面观察见到的，主要是由丝状菌与球菌组成（D对）。